COPD急性加重伴呼吸功能不全早期，为防止呼吸功能不全加重最常用的是
A. 有创机械通气
B. 无创机械通气
C. 间断高浓度吸氧
D. 持续高频呼吸机通气
E. 持续低流量吸氧

正确答案：B。无创机械通气

解析：COPD急性加重伴呼吸功能不全早期，为防止呼衰加重，应进行无创机械通气，能维持必要的肺泡通气量，改善肺的气体交换效能，使呼吸肌得以休息，有利于恢复呼吸肌功能，且无创机械通气简便易行，并发症发生率低（B对）。有创机械通气（A错）是当急性呼吸衰竭患者昏迷逐渐加深，呼吸不规则或出现暂停时行气管插管使用机械通气，而本例是呼吸功能不全早期，故无需使用有创机械通气。高浓度吸氧（C错）适用于Ⅰ型呼衰，而不用于Ⅱ型呼衰，如COPD，否则会抑制呼吸中枢，导致病情加重。持续高频呼吸机通气（D错）会导致过度通气，引起呼吸性碱中毒，不利于改善呼吸功能不全。持续低流量吸氧（E错）用于COPD的常规氧疗以及长期家庭氧疗，而本例是COPD急性加重伴呼吸功能不全，因此应以机械通气来改善通气和换气功能障碍。